甲和乙同为药品批发企业，其所持有的《药品经营许可证》载明的经营范围为麻醉药品、精神药品、医疗用毒性药品、化学原料药及其制剂、抗生素原料药及其制剂、生化药品。丙是药品零售企业，经营方式是零售（连锁）经营范围是中药饮片、中成药、化学制剂。出于经营策略的需要，甲企业决定与乙企业合并，并扩大经营范围，丙企业决定更换质量负责人并扩大经营范围。甲、乙、丙企业都能够经营的药品是
A. 第一类精神药品
B. 含麻黄碱类复方制剂
C. 第二类精神药品
D. A型肉毒素

正确答案：B。含麻黄碱类复方制剂

解析：本题考查的是药品经营范围。甲和乙同为药品批发企业，其所持有的《药品经营许可证》载明的经营范围为麻醉药品、精神药品、医疗用毒性药品、化学原料药及其制剂、抗生素原料药及其制剂、生化药品。丙是药品零售企业，经营方式是零售（连锁）经营范围是中药饮片、中成药、化学制剂。出于经营策略的需要，甲企业决定与乙企业合并，并扩大经营范围，丙企业决定更换质量负责人并扩大经营范围。甲、乙、丙企业都能够经营的药品是含麻黄碱类复方制剂（B对）。根据题干可知，甲和乙同为药品批发企业，其经营范围为麻醉药品、精神药品、医疗用毒性药品、化学原料药及其制剂、抗生素原料药及其制剂、生化药品；丙是药品零售企业，经营方式是零售（连锁）经营范围是中药饮片、中成药、化学制剂。第一类精神药品（A错）与第二类精神药品（C错）属于精神药品，A型肉毒素（D错）属于医疗用毒性药品，均超出丙的经营范围。药品经营范围包括：麻醉药品、第一类精神药品、第二类精神药品、药品类易制毒化学品、医疗用毒性药品、生物制品、药品类体外诊断试剂、中药饮片、中成药、化学药。其中，麻醉药品、精神药品、药品类易制毒化学品、医疗用毒性药品等经营范围的核定，按照国家有关规定执行；经营冷藏、冷冻药品或者蛋白同化制剂、肽类激素的，还应当在《药品经营许可证》经营范围项下予以明确。麻醉药品、第一类精神药品、药品类易制毒化学品及蛋白同化制剂、胰岛素外的肽类激素等不得列入药品零售企业持有的药品经营许可证的经营范围内。